慢性毒性试验设有4个剂量组（高、中、低、最低）及对照组，哪个剂量组为最小有作用剂量
A. 高剂量组出现了明显的中毒症状，与对照组相比P﹤0.01
B. 中剂量组出现了轻微中毒症状，与对照组相比P﹤0.05
C. 低剂量组出现了个别动物极轻微中毒症状，与对照组相比P﹥0.05
D. 最低剂量组无任何中毒症状，与对照组相比P﹥0.05
E. 对照组无任何中毒症状

正确答案：C。低剂量组出现了个别动物极轻微中毒症状，与对照组相比P﹥0.05